下列各项中最能支持慢性胰腺炎诊断的是
A. 反复发作上腹痛
B. 血糖增高
C. 粪苏丹Ⅲ染色镜下有脂肪滴
D. B超检查胰腺增大
E. CT检查胰腺增大有钙化影

正确答案：E。CT检查胰腺增大有钙化影

解析：慢性胰腺炎常有以下表现：①反复发作的上腹痛（A错）；②胰腺外分泌不全的表现：食欲减退、食后上腹饱胀、消瘦、营养不良、水肿、脂肪泻（粪苏丹Ⅲ染色镜下有脂肪滴）（C错）等；③胰腺内分泌功能不全的表现：胰腺β细胞破坏，胰岛素分泌不足，血糖增高（B错）；④腹部B超示胰腺增大（D错）、胰实质回声增强、主胰管狭窄或不规则扩张及分支胰管扩张等；⑤腹部CT检查示胰腺增大有钙化影、胰腺假性囊肿等。其中对慢性胰腺炎诊断最具特异性的是CT检查胰腺增大有钙化影（E对），最具特异性。